醌经NADPH-细胞色素P450还原酶催化-电子还原后，不可以产生
A. ·CCl₃
B. H₂O₂
C. O²⁻·
D. ·OH
E. 氢过氧化自由基

正确答案：A。·CCl₃